不符合肺炎支原体肺炎X线改变的是
A. 间质性肺炎改变
B. 均质性的片状阴影
C. 支气管肺炎改变
D. 多发空洞
E. 肺门阴影增浓

正确答案：D。多发空洞

解析：支原体肺炎属于间质性肺炎（A对），炎症累及肺间质、支气管（C对）、细支气管等部位，X线片显示均质性的片状阴影（B对），有的患者病情从肺门附近向外伸展，显示肺门阴影增浓（E对）。肺炎支原体肺炎不侵入肺实质，因此无多发空洞（D错，为本题正确答案），多发空洞多见于金黄色葡萄球菌肺炎。